囊虫病的传染源
A. 猪
B. 蚊
C. 鼠
D. 猪肉绦虫病人
E. 螨

正确答案：D。猪肉绦虫病人

解析：囊尾蚴病的唯一传染源是猪肉绦虫病人（D对）。患者粪便排出的虫卵对其自身和其周围人群均具有传染性，猪带绦虫寄生在人小肠内的寿命较长，感染期限越长，发生该病危险性也越大，人既是猪带绦虫的唯一终宿主，又是其中间宿主。猪（A错）是乙脑的传染源之一，蚊（B错）是乙脑的传播途径，鼠（C错）是肾综合征出血热的主要传染源，螨（E错）是恙虫病的传播媒介，以上都不是囊虫病的传染源。